正常人脑脊液中糖的最低含量为
A. 4.0mmol/L
B. 3.5mmol/L
C. 3.0mmol/L
D. 2.5mmol/L
E. 2.0mmol/L

正确答案：D。2.5mmol/L

解析：正常人脑脊液中葡萄糖含量为2.5～4.4mmol/L，最低含量为2.5 mmol/L（D对）。